下列有关胆碱酯酶复活剂应用的叙述，正确的是
A. 两种以上复活剂同时使用不增加毒性
B. 复活剂对毒蕈碱样作用较强
C. 复活剂可与碱性药物并用
D. 中毒已超过3日，使用复活剂无效
E. 与阿托品合用无协同作用

正确答案：D。中毒已超过3日，使用复活剂无效

解析：本题考查胆碱酯酶复活剂。下列有关胆碱酯酶复活剂应用的叙述，正确的是中毒已超过3日，使用复活剂无效（D对）。中毒已超过3日或慢性中毒患者体内的乙酰胆碱酯酶已老化，使用复活剂无效。应用胆碱酯酶复活剂切勿两种或三种复活剂同时应用，以免其毒性增加（A错）。复活剂对解除烟碱样作用（特别是肌肉纤维颤动）和促使昏迷患者苏醒的作用比较明显；对毒蕈碱样作用和防止呼吸中枢抑制的作用较差（B错），故与阿托品合用可取得协同效果（E错）。胆碱酯酶复活剂在碱性溶液中不稳定，可以水解生成剧毒的氮化物，故不能与碱性药物合用（C错）。